如果寿命表中死亡人数分布中婴幼儿峰度上升，老年峰位置前移是说明居民的健康水平
A. 提高
B. 降低
C. 没有变化
D. 还不能下结论

正确答案：B。降低

解析：本题考查寿命表的相关内容。如果寿命表中死亡人数分布中婴幼儿峰度上升，老年峰位置前移是说明居民的健康水平降低（B对ACD错）。